当某种因素与疾病无关联时
A. RR＝0
B. RR＞0
C. RR＜1
D. RR＞1
E. RR＝1

正确答案：E。RR＝1

解析：本题考查相对危险度与关联的强度。当RR＝1（E对ABCD错）时，说明疾病与暴露之间无关联。